胸腔积液量约400mL
A. X线示肋膈角变钝
B. X线示大片状、边缘模糊阴影
C. X线示斑片状、边缘模糊阴影
D. X线示凸面指向肺内呈“D”字征阴影
E. X线示上缘呈向外侧升高的反抛物线阴影

正确答案：E。X线示上缘呈向外侧升高的反抛物线阴影

解析：正常人胸腔液小于20mL。300～500ml为少量胸腔积液；500-800ml为中等量胸腔积液；＞800ml为大量胸腔积液。胸腔积液的X先表现与积液量、是否有包裹或粘连有关。少量胸腔积液时仅见肋膈角变钝（A错），中等量胸腔积液显示有向外侧、向上的弧形上缘的积液影，＜300 肋膈角变钝 ；300-500反抛物线 ；＞500气管被推向健侧（E对）。X线示大片状、边缘模糊阴影多为肺脓肿早期X线表现（P59）（B错）。X线示斑片状边缘模糊阴影为大叶性肺炎表现（P47）（C错）。X线示凸面指向肺内呈“D”字征阴影见于包裹性胸腔积液（D错）。